患者，男，35岁。头痛连及项背，恶风畏寒，口不渴，舌苔薄白，脉浮紧。治疗应首选
A. 瓜蒌桂枝汤
B. 川芎茶调散
C. 葛根汤
D. 防风汤
E. 增液汤

正确答案：B。川芎茶调散

解析：题中患者以头痛连及项背为主症，故诊断为头痛。头痛连及项背为风寒外袭，阻遏太阳经气，太阳经脉循项背上行巅顶所致；寒为阴邪，而津液未伤，故口不渴；风寒束于肌表，卫阳被遏，故恶风畏寒；舌苔薄白，脉浮紧为风寒在表之象，故辨为风寒头痛，治宜疏风散寒。瓜蒌桂枝汤功能和营养津，为痉证柔痉的选方（A错）。题中辨为风寒头痛，治宜疏风散寒，首选川芎茶调散（B对）。葛根汤功能解肌发汗，为痉证刚痉的选方（C错）。防风汤功能发散风寒，祛湿通络，为行痹的选方（D错）。增液汤功能增液润燥，主治阳明温病，津亏便秘证（E错）。